在800名病例与800名对照的病例对照研究中，有300名病例和100名对照有暴露史，OR值应为
A. 1.4
B. 2.3
C. 4.2
D. 无法计算
E. 5

正确答案：C。4.2

解析：根据OR定义计算，病例中有暴露史为300（a）人，对照组有暴露史100（b），病例中无暴露史500（c）人，对照组无暴露史700（d）人。OR=（a/c）/（b/d）=4.2（C对）。